细胞色素氧化酶（aa3）中除含铁卟啉外还含有
A. Mn
B. Zn
C. Co
D. Mg
E. Cu

正确答案：E。Cu